与其他抗真菌药无交叉耐药性的棘白霉素类抗真菌药是
A. 两性霉素
B. 卡泊芬净
C. 氟胞嘧啶
D. 阿糖胞苷
E. 酮康唑

正确答案：B。卡泊芬净

解析：本题考查卡泊芬净。与其他抗真菌药无交叉耐药性的棘白霉素类抗真菌药是卡泊芬净（B对）。棘白霉素类抗真菌药有卡泊芬净、米卡芬净、阿尼芬净，具有广谱抗真菌活性，与其他抗真菌药无交叉耐药性。两性霉素B（A错）为多烯类抗真菌药。氟胞嘧啶（C错）为其他抗真菌药。阿糖胞苷（D错）是干扰核酸生物合成的抗肿瘤药物，非抗真菌药物。酮康唑（E错）是咪唑类抗真菌药。